深部脓肿的诊断方法，应首选
A. 点压法
B. 按触法
C. 透光法
D. 穿刺法
E. X线摄片

正确答案：D。穿刺法

解析：若脓液不多且位于组织深部时，用按触法辨脓有困难，可直接采用穿刺法（D对）抽脓诊断。点压法（A错）适用于在患指部，当病灶处脓液很少的情况下。按触法（B错）适用于脓液处于浅表部位的情况下。透光法（C错）适用于指、趾部皮下及甲下的辨脓。X线法（E错）适用于准确定位脓肿部位、大小。